组胺H₂受体阻断的抑酸作用强度比较，正确的是
A. 法莫替丁＞雷尼替丁＞西咪替丁
B. 西咪替丁＞雷尼替丁＞法莫替丁
C. 雷尼替丁＞法莫替丁＞西咪替丁
D. 雷尼替丁＞西咪替丁＞法莫替丁
E. 法莫替丁＞西咪替丁＞雷尼替丁

正确答案：A。法莫替丁＞雷尼替丁＞西咪替丁

解析：本题考查组胺H₂受体阻断的抑酸作用强度。法莫替丁口服吸收迅速但不完全，口服生物利用度约50%，且不受食物影响。其抑制胃酸分泌作用比西咪替丁强20倍，比雷尼替丁强7.5倍。故抑酸作用强度比较：法莫替丁＞雷尼替丁＞西咪替丁（A对）。